有关继发性结核发生的描述不正确的是
A. 继发性结核可以是内源性复发，也可以是外源性重染
B. 内源性复发是指原发结核感染后重新活动而发生的结核病
C. 外源性重染是指由于受到结核分枝杆菌的再感染而发病
D. 继发性结核痰涂片均为阳性
E. 继发性结核有传染性

正确答案：D。继发性结核痰涂片均为阳性